患者，男，64岁，身高174cm，体重92kg。既往有高血压、高脂血症及心肌梗死病史，今日因反复胸闷就诊，临床处方，阿司匹林肠溶片、辛伐他汀片、特拉唑嗪片、氨氯地平片、曲美他嗪片、单硝酸异山梨酯注射液进行治疗。关于本病例隔离用药指导意见的说法，错误的是
A. 应注意监护血压变化，防止血压过度降低
B. 患者使用抗血小板聚集药物时，应注意预防出血
C. 单硝酸异山梨酯能扩张血管引起头痛，即使可耐受也必须停药
D. 出现弥漫性肌痛或乏力，同时伴全身不适时，应及时就医
E. 口服阿司匹林肠溶片不要嚼碎服用或掰开服用

正确答案：C。单硝酸异山梨酯能扩张血管引起头痛，即使可耐受也必须停药

解析：本题考查用药指导。单硝酸异山梨酯注射液耐受后，可以继续服用单硝酸异山梨酯口服制剂（C错，为本题正确答案）。抗血压药物使用期间应该注意监护血压水平（A对）。抗血小板聚集药阿司匹林的不良反应为出血，应注意预防（B对）。服用降脂药物剂量过大或体内药物蓄积过多会出现弥漫性肌痛或乏力等症状，应及时就医（D对）。阿司匹林肠溶片不能嚼碎或掰开服用，整片吞服才能达到肠溶的效果（E对）。